2型糖尿病患者，女，60岁，因服用降糖药达格列净出现尿路感染就诊，医师建议改用胰岛素类药物治疗。达格列净系由天然产物结构修饰而来，该天然产物是
A. 根皮苷
B. 胰岛素
C. 阿卡波糖
D. 芦丁
E. 阿魏酸

正确答案：A。根皮苷

解析：本题考查根皮苷。达格列净系由天然产物结构修饰而来，该天然产物是根皮苷（A对），其是从苹果树根皮中分离出来的。胰岛素（B错）最初是从牛胰岛中提取出来的，后都是人工合成的。阿卡波糖（C错）来自土壤细菌。芦丁（D错）属维生素类药，有降低毛细血管通透性和脆性的作用。阿魏酸（D错）在植物细胞壁中，与多糖和木质素交联构成细胞壁的一部分，具有多种生物活性，具有抗氧化，抗血栓，抗癌，消炎等多种作用。